以下关于环境卫生管理的原则，错误的是
A. 操作规范
B. 要有计划，有重点进行管理
C. 及时掌握实情
D. 连续系统地监测
E. 本部门独立工作

正确答案：E。本部门独立工作